女性，18岁。发热伴鼻出血5日。查体全身淋巴结肿大，皮肤散在出血斑，肝肋下2cm，脾肋下3cm，血红蛋白80g/L，白细胞12×10⁹/L，血小板40×10⁹/L，骨髓增生活跃，原始细胞占0.80，过氧化物酶染色阴性，非特异性酯酶阴性。首选治疗方案
A. HA
B. DA
C. VP
D. CHOP
E. MOPP

正确答案：C。VP

解析：患者青年女性，发热伴鼻出血5日，皮肤散在出血斑（贫血、出血、感染是白血病患者正常骨髓造血功能受抑制的表现），查体全身淋巴结肿大（淋巴结肿大以ALL较多见），肝肋下2cm，脾肋下3cm（急性白血病时肝脾肿大多为轻至中度），血红蛋白80g/L（成年女性Hb正常值110～150g／L），提示贫血，血小板40×10⁹／L（正常100～300×10⁹/L，白血病患者血小板常减少），外周血白细胞12×10⁹／L（正常4～10×10⁹／L）增多，骨髓增生活跃，原始细胞占0.80（原始细胞≥骨髓有核细胞（ANC）的30%（FAB分型）或≥20%（WHO分型）即可诊断为急性白血病），提示急性白血病，过氧化物酶染色阴性（排除急性粒细胞白血病），非特异性酯酶阴性（排除急性单核细胞白血病），故最可能的诊断是急性淋巴细胞白血病（ALL）。ALL首选的治疗方案为VP（长春新碱+泼尼松）方案（C对）。HA方案（P576）（A错）、DA方案（P576）（B错）是急性髓系白血病常用的治疗方案；CHOP方案（P590）（D错）是侵袭性非霍奇金淋巴瘤的标准治疗方案；MOPP方案（P585）（E错）曾是霍奇金淋巴瘤的首选治疗方案，现已被ABVD方案代替。